使用恢复期血清可提供哪一类免疫
A. 自然自动免疫
B. 自然被动免疫
C. 人工自动免疫
D. 人工被动免疫
E. 被动自动免疫

正确答案：D。人工被动免疫